某药物具有非线性消除药动学特征，其药动学参数中，随着给药剂量的增加而减小的是
A. 半衰期（t1/2）
B. 表观分布容积（V）
C. 药物浓度-时间曲线下面积（AUC）
D. 清除率（Cl）
E. 达峰时间（tmax）

正确答案：D。清除率（Cl）

解析：本题考查药动学参数。随着给药剂量的增加而减小的是清除率（D对）；非线性消除的药物，剂量增加半衰期延长，清除率降低；生物半衰期（A错）指药物在体内的量或血药浓度降低一半所需的时间，以符号t1/2表示，一级动力学消除时t1/2为常数，不因给药剂量而改变；非线性消除的药物，其生物半衰期随剂量的增加而增加；表观分布容积（V）（B错）为药物在体内的分布情况；药物浓度-时间曲线下面积（AUC）（C错）反映药物吸收程度；达峰时间（tmax）（E错）反应药物在体内的吸收速度。